增强牙对龋病抵抗力
A. 服维生素C
B. 饭后刷牙
C. 窝沟封闭
D. 护牙托
E. 用吸管饮用饮料

正确答案：C。窝沟封闭

解析：本题考查龋病的预防。可增强牙对龋病抵抗力的是窝沟封闭（C对）。窝沟封闭又称点隙窝沟封闭，是指不去除牙体组织，在牙合面、颊面或舌面的点隙窝沟涂布一层树脂或玻璃离子材料，保护牙釉质不受细菌及代谢产物侵蚀，达到预防龋病发生的一种有效防龋方法。窝沟封闭使用的黏性高分子材料，包括树脂、玻璃离子等称为窝沟封闭剂。服维生素C（A错）可预防坏血病、传染病、紫癜等。饭后刷牙（B错）会刮掉牙釉质、帮助酸性物质扩散、出现牙本质过敏症，对牙齿健康不利。护牙托（D错）可预防运动中牙外伤。用吸管饮用（E错）可减少酸性饮料接触牙面的时间，预防酸蚀症。